下颌横断（牙合）片
A. 是口内片的一种，可用于检查下颌骨体部骨质有无膨隆
B. 是口外片的一种，可用于检查颏孔位置
C. 是根尖片的一种，可用于腮腺导管阳性结石
D. 也称分角线投照技术，可用于检查邻面龋
E. 也称平行投照技术，可用于检查牙槽嵴顶高度

正确答案：A。是口内片的一种，可用于检查下颌骨体部骨质有无膨隆

解析：本题考查下颌横断（牙合）片。下颌横断（牙合）片常用于观察下颌骨体部颊舌侧骨质改变情况、异物及阻生定位、下颌骨骨折时颊舌向移位情况、颌下腺导管阳性结石等，是一种口内片（A对），而不是口外片（B错）。根尖片（C错）包括上颌根尖片和下颌根尖片，与下颌横断（牙合）片同属于口内片，用于诊断根尖处的病变。检查邻面龋（D错）和牙槽嵴顶高度（E错）多采用咬（牙合）翼片而不是下颌横断（牙合）片。